湿润剂的HLB值为
A. 1-2
B. 3-8
C. 7-9
D. 8-16
E. 17-20

正确答案：C。7-9

解析：本题考查表面活性剂的应用。湿润剂的HLB值为7～9（C对）。润湿剂：可提高饮片表面的润湿性而促进浸提、提高片剂的表面润湿性而加快崩解、提高混悬微粒的表面润湿性而促进分散等。HLB值在7～9的表面活性剂适合用作润湿剂。乳化剂：使两种或两种以上互不相溶的组合混合液体形成稳定的乳状液。HLB值在8～16（D错）的表面活性剂适合用作O/W型乳化剂；HLB值在3～8（B错）的表面活性剂适合用作W/O型乳化剂。